血胸欲行胸腔闭式引流术的最佳引流位置是
A. 腋前线第6～8肋间
B. 腋前线与腋中线之间第6～8肋间
C. 腋中线第6～8肋间
D. 腋中线与腋后线之间第6～8肋间
E. 腋后线第6～8肋间

正确答案：D。腋中线与腋后线之间第6～8肋间

解析：血胸行胸腔闭式引流术的位置为腋中线与腋后线间第6或第7肋间隙，即腋中线与腋后线之间第6～8肋间（D对）。